核酸探针是指
A. 不同的核酸链经变性处理，它们之间形成局部的双链
B. 标记一个已知序列核酸，通过杂交反应确定待测核酸是否含有相同的序列
C. 运输氨基酸
D. 单股DNA恢复成双股DNA
E. 50％双链DNA变性时的温度

正确答案：B。标记一个已知序列核酸，通过杂交反应确定待测核酸是否含有相同的序列

解析：不同来源的DNA可以杂交，DNA与RNA、RNA与RNA之间也可以杂交。若标记一个已知序列的核酸，通过杂交反应就可以确定待测核酸是否含有与之相同的序列。这种标记的核酸称为探针。掌握“DNA”知识点。